对β受体有阻断作用的药物是
A. 可乐定
B. 哌唑嗪
C. 普萘洛尔
D. 琥珀胆碱
E. 去甲肾上腺素

正确答案：C。普萘洛尔

解析：本题考查影响药物吸收的剂型因素。普萘洛尔（C对）为非选择性β受体阻断剂，能够阻断β₁和β₂受体；可乐定（A错）是α₂受体激动药；哌唑嗪（B错）为α₁受体阻断剂；琥珀胆碱（D错）为非竞争性肌松药；去甲肾上腺素（E错）为α受体激动药，对α₁、α₂均有效。